单纯二尖瓣狭窄患者发生活动后心悸、呼吸困难的主要机制是
A. 左心室射血阻力增大
B. 左心房排血受阻
C. 左心室收缩力降低
D. 左心室容量负荷过重
E. 血容量增多

正确答案：B。左心房排血受阻

解析：单纯性二尖瓣狭窄，左心房排血受阻（B对），左心房压力升高，导致肺静脉和肺毛细血管压力升高，继而导致肺淤血；活动后心率增快，舒张期缩短，左心房压更高，进一步增加肺毛细血管压力，进而出现呼吸困难、咳嗽、发绀等临床表现。